常作为寻找腮腺导管口标志的是
A. 下颌第一磨牙
B. 上颌第一磨牙
C. 下颌第二磨牙
D. 上颌第二磨牙
E. 第三磨牙

正确答案：D。上颌第二磨牙

解析：本题考查上下颌磨牙的外形及临床应用解剖。寻找腮腺导管口的标志为上颌第二磨牙（D对）相对应的颊黏膜上。